在胞质中进行的和能量代谢有关的代谢是
A. 三羧酸循环
B. 脂肪酸氧化
C. 电子传递
D. 糖酵解
E. 氧化磷酸化

正确答案：D。糖酵解